男，6岁。浮肿尿色红2天入院，查体：颜面眼睑浮肿，心肺听诊无异常，尿常规有红细胞（+++），蛋白（+），半月前患过扁桃体炎发生上述情况，若患儿在病程中出现精神萎靡，水肿加重，尿量减少，氮质血症，血钾增高和代谢性酸中毒，BP120/80mmHg，首先应采取的措施是
A. 使用降压药物
B. 加抗生素的应用
C. 使用强心剂
D. 补充电解质
E. 血液透析

正确答案：E。血液透析

解析：出现急性肾功能不全时，由于患儿情况危急，有严重的高钾血症和代谢性酸中毒，并出现了氮质血症，符合透析指征，故首先考虑血液透析（E对）。本例患儿血压BP120/80mmHg，属正常范围，无需使用降压药物（A错），加在抗生素的应用（B错）可用于控制感染，不是本病首选治疗，无心衰表现，无需使用强心剂（C错），无电解质丧失，无需补充电解质（D错）。